当股四头肌麻痹时，主要不能
A. 伸大腿
B. 内收大腿
C. 旋转大腿
D. 屈小腿
E. 伸小腿

正确答案：E。伸小腿

解析：股四头肌的主要作用是屈髋关节和伸膝关节。当股四头肌麻痹时，则不能伸膝关节，即伸小腿（E对）。